口角炎可以使用的治疗药物是
A. 维生素A
B. 维生素D
C. 维生素B₁
D. 维生素B₂
E. 维生素B₆

正确答案：D。维生素B₂

解析：本题考查维生素B₂。维生素B₂（D对）用于防治维生素B₂缺乏症，如口角炎。维生素A（A错）用于防治维生素A缺乏症，如夜盲症。维生素D（B错）有助于人体吸收钙、磷。维生素B₁（C错）用于维生素B₁缺乏所致的脚气病。维生素B₆（E错）用于维生素B₆缺乏时的预防和治疗。